男，56岁。活动后气短，伴间断咳嗽、咳少量白黏痰半年。吸烟30年，20支/天。查体未见阳性体征。血常规及胸部X线片未见异常。为明确诊断，宜首选的检查是
A. 超声心动图
B. 动脉气血分析
C. 肺部CT
D. 肺功能
E. 支气管镜

正确答案：D。肺功能

解析：中年男性患者，活动后气短（慢阻肺的标志性症状），伴间断咳嗽、咳少量白黏痰半年。吸烟30年，20支/天。查体未见阳性体征。血常规及胸部X线片未见异常。综合患者的症状、体征和辅助检查，初步诊断为慢性阻塞性肺疾病，为明确诊断，宜首选的检查是肺功能（D对），持续性气流受限是慢阻肺诊断的必备条件。超声心动图（A错）主要用于检查心功能。动脉气血分析（B错）主要用于诊断呼吸衰竭。肺部CT（C错）可见慢阻肺小气道病变的表现、肺气肿的表现以及并发症的表现，但其主要临床意义在于排除其他具有相似症状的呼吸系统疾病。支气管镜（E错）主要用于诊断气管与支气管疾病。